在城镇，发现甲类传染病病人、病原携带者或疑似病人时，应在多少小时内报告给发病地区所属的县(区)卫生防疫机构
A. 2小时内
B. 3小时内
C. 5小时内
D. 6小时内
E. 12小时内

正确答案：A。2小时内

解析：本题考查疫情报告制度。《中华人民共和国传染病防治法》规定，责任报告单位和责任疫情报告人发现甲类传染病和乙类传染病中的肺炭疽、传染性非典型肺炎等按照甲类管理的传染病病人或疑似病人时，或发现其他传染病和不明原因疾病暴发时，应于2小时（A对BCDE错）内将传染病报告卡通过网络报告。